医师注册后有下列情形之一的，其所在的医疗、预防、保健机构应当在三十日内报告准予注册的卫生行政部门，卫生行政部门应当注销注册，收回医师执业证书，除了
A. 中止执业医师满二年的
B. 受吊销医师执业证书行政处罚的
C. 死亡或者被宣告失踪的
D. 中止医师执业活动满一年的
E. 有国务院卫生行政部门规定不宜从事医疗、预防、保健业务的其他情形的

正确答案：D。中止医师执业活动满一年的

解析：中止医师执业活动满2年的（D错，为本题正确答案），其所在的医疗、预防、保健机构应当在三十日内报告准予注册的卫生行政部门，卫生行政部门应当注销注册，收回医师执业证书。